利尿作用强，常用于治疗严重水肿的药物是
A. 呋塞米
B. 氢氯噻嗪
C. 阿米洛利
D. 氨苯蝶啶
E. 螺内酯

正确答案：A。呋塞米

解析：本题考查呋塞米的临床作用。利尿作用强，常用于治疗严重水肿的药物是呋塞米（A对）。呋塞米为高效能利尿药，可治疗心、肝、肾等各类水肿。主要用于其他利尿药无效的严重水肿患者。氢氯噻嗪（B错）是中效能利尿药，可用于各种原因引起的水肿。对轻、中度心源性水肿疗效较好，是慢性心功能不全的主要治疗措施之一。阿米洛利（C错）是留钾利尿药，临床用于治疗充血性心力衰竭、肝硬化腹水和肾病综合征等水肿性疾病以及肾上腺糖皮质激素治疗过程中发生的水钠潴留。氨苯蝶啶（D错）是留钾利尿药，在临床上用于治疗各种水肿，常与排钾利尿药合用治疗顽固性水肿。螺内酯（E错）是醛固酮受体阻断剂，用于治疗与醛固酮升高有关的顽固性水肿，对肝硬化和肾病综合征水肿患者较为有效。